淋巴结叙述错误的是
A. 淋巴器官组成部分
B. 位于躯体较隐蔽处
C. 输入淋巴管与其凸侧相连
D. 输出淋巴管数目少于输入淋巴管
E. 数目较多，常集聚成群

正确答案：D。输出淋巴管数目少于输入淋巴管

解析：淋巴结是淋巴器官组成部分（A对），淋巴器官包括淋巴结、胸腺、脾和扁桃体。淋巴结数目较多，常聚集成群（E对），青年人约有400～450个，淋巴结常位于关节屈侧或身体较隐蔽处（B对），如肘窝、腘窝、腋窝、腹股沟管、脏器门和大血管附近。淋巴结一侧凸隆一侧凹陷，凸侧连接输入淋巴管（C对），凹侧中央有淋巴结门。连接输出淋巴管，一个淋巴结的输出淋巴管可能成为另一个淋巴结的输入淋巴管，所以不存在输出淋巴管数目少于输入淋巴管的情况（D错，为本题正确答案）。